酸枣仁汤主治证候的病因病机是
A. 心脾两虚，气血不足
B. 心阴不足，肝气失和
C. 心肾两亏，阴虚血少
D. 肝血不足，虚热内扰
E. 心阳偏亢，心肾不交

正确答案：D。肝血不足，虚热内扰

解析：酸枣仁汤方含酸枣仁、甘草、知母、茯苓、川芎以养血安神，清热除烦。主治肝血不足，虚热内扰之虚烦不眠证。虚烦失眠，心悸不安，头目眩晕，咽干口燥，舌红，脉弦细。肝藏血，血舍魂；心藏神，血养心。肝血不足，则魂不守舍；心失所养，加之阴虚生内热，虚热内扰，故虚烦失眠、心悸不安。血虚无以荣润于上，每多伴见头目眩晕、咽干口燥。舌红，脉弦细乃血虚肝旺之征（D对）。